Ⅴ类洞充填备洞时，要求
A. 严格的抗力形
B. 适当的固位形
C. 底平壁直
D. 口小底大
E. 必须做鸠尾

正确答案：B。适当的固位形

解析：本题考查V类洞预备要点。Ⅴ类洞不直接承受咬合力，抗力形无需严格要求（A错）。但在咬合运动中，侧方（牙合）运动使牙受到颊、舌方向的力，在此力下会出现充填体与洞壁分离的趋势，应在（牙合）轴线角和龈轴线角做倒凹或固位沟，防止充填体移位脱落（B对）。颈部的牙面呈弧形，为使洞深一致，又不损伤牙龈，洞底应呈与牙面弧度一致的弧面，以免磨平洞底，造成意外穿髓（CD错）。鸠尾通常用于双面洞，Ⅴ类洞为单面洞，无需做鸠尾（E错）。